男性，22岁，既往有HBsAg阳性史，10天前无诱因发烧，体温逐渐上升，波动于37.5～39℃，近3天体温持续在38.5～39.5℃不降，伴有食欲不振乏力腹胀及尿黄。查体：T39.5℃，P88次/分，BP110/70mmHg，神清，表情淡漠，未见皮疹，巩膜轻度黄染，心肺未见异常，腹软，右下腹压痛（+），肝右肋下2cm，脾未触及，肝浊音区不小，移动性浊音阴性，双下肢无浮肿。化验：WBC3.5×10⁹/L，N60%，L40%，血HBsAg（+），抗-HAV-IgG（+）。该患者可能发生的严重并发症是
A. 心肌炎
B. 急性胆囊炎
C. 肠出血肠穿孔
D. 支气管肺炎
E. 肝昏迷

正确答案：C。肠出血肠穿孔

解析：22岁男性患者，既往有HBsAg阳性史（无症状携带者或慢性乙肝患者），10天前无诱因发烧，一周后高热不降（最早出现发热，热度呈阶梯形上升，稽留热），伴有食欲不振乏力腹胀及尿黄（伤寒的全身症状）。查体：T39.5℃，P88次/分，BP110/70mmHg，神清，表情淡漠，未见皮疹，巩膜轻度黄染，心肺未见异常，腹软，右下腹压痛（+）（伤寒的典型体征），肝右肋下2cm（肝脏增大），脾未触及，肝浊音区不小，移动性浊音阴性，双下肢无浮肿。化验：WBC3.5×10⁹/L（成人正常参考值4～10×10⁹/L），N60％，L40%，血HBsAg（+）（无症状携带者或慢性乙肝患者），抗-HAV-IgG（+）（既往感染HAV或免疫接种后），根据患者的病史、临床症状和实验室数据，可知患者有稽留热，表情淡漠，右下腹压痛，白细胞减低等表现，应考虑存在伤寒，急性黄疸型乙型肝炎少见，结合既往有HBsAg阳性史，急性乙型肝炎可能性小，抗-HAV-IgG阳性是既往感染HAV或免疫接种后的标志，可长期存在，不能作为甲肝的诊断依据，综合考虑该患者最可能的诊断是伤寒、乙肝表面抗原携带者。伤寒的并发症有：①肠出血；②肠穿孔；③中毒性肝炎；④中毒性心肌炎（A错）；⑤其他并发症，如中毒性脑病、急性胆囊炎（B错）、支气管肺炎（D错）、肝昏迷（E错）等。其中最严重的并发症是肠穿孔，最常见的并发症是肠出血（C对）。